据报道，现在有些医院已采取了一些隔离措施，使体格检查置于一个相对封闭的环境中，以免受检患者曝光于众人面前。更确切地说这些措施反映了医院和医生哪一种医德意识
A. 服务意识
B. 管理意识
C. 保护患者隐私意识
D. 有利于患者的意识
E. 热爱医学事业的意识

正确答案：C。保护患者隐私意识